关于设对照组的前后测试，下列陈述不正确的是
A. 目标人群在项目实施前后的情况进行比较
B. 可剔除时间、测量因索对结果的影响
C. 可剔除观察因素对结果的影响
D. 对干预效果作出有说服力的解释
E. 为干预组选择一个匹配的对照组

正确答案：A。目标人群在项目实施前后的情况进行比较